诊断膀胱肿瘤最可靠的方法是
A. 尿常规检查
B. 尿细胞学
C. 膀胱造影
D. 膀胱B超
E. 膀胱镜检查+活检

正确答案：E。膀胱镜检查+活检

解析：诊断膀胱肿瘤最可靠的方法是膀胱镜检查+活检（E对），准确率接近100%。尿常规检查（A错）为泌尿系疾病的一般常规检查，无特异性。尿细胞学（B错）可作为泌尿系肿瘤的筛查措施，但不能确定肿瘤的部位。膀胱造影（C错）显示充盈缺损提示膀胱肿瘤的可能，但可靠性不及膀胱镜活检。膀胱B超（D错）简便易行，能发现直径0.5cm以上的肿瘤，多用于病人的初筛检查。